甲生物制品研发企业基于临床治疗需求，研发上市了一款针对PDL-1靶点用于肿瘤免疫治疗的新药，对多种肿瘤疾病疗效显著。为提升该药品的生产供应能力，甲计划在生产供应不足的情况下，同时委托乙药品生产企业生产，该新药销售由甲承担。下列说法，符合国家药品管理相关注律法规规定的是
A. 由于乙产能不足，乙再次委托其他药品生产企业生产该药品
B. 由于乙配送能力不足，乙再次委托其他药品批发企业配送该药品
C. 甲委托乙向医疗机构开具该药品的销售票据
D. 委托乙生产后，甲不再单独配备不良反应监测人员

正确答案：B。由于乙配送能力不足，乙再次委托其他药品批发企业配送该药品

解析：本题考查委托运输的主要内容。符合国家药品管理相关注律法规规定的是乙配送能力不足，乙再次委托其他药品批发企业配送该药品（B对）。委托运输：企业委托其他单位运输药品的，应当对承运方运输药品的质量保障能力进行审计，索取运输车辆的相关资料，符合相关运输设施设备条件和要求的方可委托；应当与承运方签订运输协议，明确药品质量责任、遵守运输操作规程和在途时限等内容；应当有记录，实现运输过程的质量追溯。记录至少包括发货时间、发货地址、收货单位、收货地址、货单号、药品件数、运输方式、委托经办人、承运单位，采用车辆运输的还应当载明车牌号，并留存驾驶人员的驾驶证复印件。药品委托生产管理：委托生产时应与符合条件的药品生产企业签订委托协议和质量协议，将相关协议和实际生产场地申请资料合并提交至药品上市许可持有人所在地省（区、市）药品监督管理部门申请办理《药品生产许可证》。受托方不得将接受委托生产的药品再次委托第三方生产（A错）。药品批发企业销售含特殊药品复方制剂时，必须按规定开具销售票据提供给购货单位。销售票据、资金流和物流必须一致（C错）。药品不良反应监测与报告：企业质量管理部门应当配备专职或者兼职人员，按照国家有关规定承担药品不良反应监测和报告工作（D错）。